牛奶中碳水化合物的存在形式为
A. 葡萄糖
B. 果糖
C. 乳糖
D. 半乳糖
E. 糖原

正确答案：C。乳糖